针刺皮肤浅薄部位的腧穴，最适宜采用的进针方法
A. 指切进针法
B. 夹持进针法
C. 舒张进针法
D. 提捏进针法
E. 以上都可以

正确答案：D。提捏进针法

解析：浅薄部位的腧穴进针时需要把皮肤捏起再进针，为提捏进针法（D对）。指切进针法适用于短针的进针（A错）；夹持进针法适用于长针的进针（B错）；舒张进针法主要用于皮肤松弛部位的腧穴（C错）。